槟榔的别名为
A. 南豆根
B. 冰台
C. 坤草
D. 国老
E. 海南子

正确答案：E。海南子

解析：本题考查的是常见的饮片正名与相关别名。山豆根的别名为南豆根（E对）。槟榔别名：花槟榔、大腹子、海南子。南豆根（A错）为山豆根的别名。山豆根别名：广豆根、南豆根。冰台（B错）为艾叶的别名。艾叶别名：祁艾、蕲艾、炙草、冰台。坤草（C错）为益母草的别名。益母草别名：坤草、茺蔚、益明。国老（D错）为甘草的别名。甘草别名：粉甘草、皮草、国老。